热辐射能量大小主要取决于
A. 环境的温度
B. 环境的湿度
C. 辐射源的温度
D. 辐射源的湿度
E. 周围物体表面温度

正确答案：C。辐射源的温度

解析：本题考查热辐射能量决定因素。热源辐射的能量大小取决于辐射源的温度（C对ABDE错）、表面积和表面温度等，热源温度愈高，表面积愈大，辐射能量也愈大，辐射源的温度是影响热源辐射大小最重要的因素。另一方面，辐射能量与辐射源距离的平方成反比，离辐射热源越远，物体受到的辐射强度也越小。